青少年心身发展的特点
A. 人格逐渐形成
B. 性心理不断成熟
C. 情绪体验敏感而不稳定
D. 认知功能全面和均衡发展
E. 以上说法均正确

正确答案：E。以上说法均正确

解析：心理发展快，心理功能不断完善，体质发育快，生理功能不断成熟，①认知功能全面和均衡发展；②情绪体验敏感而不稳定；③人格逐渐形成；④性心理不断成熟。掌握“不同年龄阶段心理卫生”知识点。